支架变形的原因不包括
A. 印模材料质量不好
B. 设计不当
C. 铸道设置不合理
D. 模型缺损
E. 高温包埋材料的热膨胀系数不够

正确答案：B。设计不当

解析：本题考查支架变形的原因。支架变形的原因不包括设计不当（B错，为本题的正确答案）。设计不当与支架变形一样，会引起义齿就位困难和翘动，二者为并列关系而不是从属关系。铸造支架变形可导致试戴时卡环无固位力或经调磨后不能就位，其原因包括印膜材料质量不好（A对）而导致的在翻制模型过程中造成阴模收缩变形、铸道设计不合理（C对）而导致的支架各部分不均匀收缩、模型缺损（D对）以及高温包埋材料的热膨胀系数不够（E对）而导致的不能补偿铸造后金属的收缩等。